手术中不慎将肛管直肠环完全切断，会导致
A. 肛门狭窄
B. 肛门失禁
C. 直肠脱垂
D. 排便困难
E. 肛痈形成

正确答案：B。肛门失禁

解析：外括约肌的深、浅二部围绕直肠纵肌及肛门内括约肌并联合肛提肌的耻骨直肠肌，环绕肛管、直肠连接处，组成一肌环，称为肛管直肠环。手术时切断肛管直肠环可引起肛门失禁（B对）。